不属于拔牙创正确处理方法的是
A. 牙槽窝应作压迫复位
B. 撕裂的牙龈应予以缝合
C. 过高的牙槽中隔应修整
D. 刮净拔牙创内的肉芽组织
E. 拔除乳牙残根后彻底搔刮牙槽窝

正确答案：E。拔除乳牙残根后彻底搔刮牙槽窝

解析：乳牙拔除后不要搔刮拔牙窝，以免损伤恒牙胚。掌握“牙拔除术”知识点。